《中国药典》一部规定，测定中药水分的方法有
A. 烘干法
B. 甲苯法
C. 远红外干燥法
D. 减压干燥法
E. 气相色谱法

正确答案：A、B、D、E。烘干法；甲苯法；减压干燥法；气相色谱法